关于抗原因素对免疫耐受形式哪项是正确的
A. 抗原的持续存在是维持免疫耐受的重要条件
B. 耐受原多为大分子颗粒性物质
C. 抗原有多种不同的决定簇易形成耐受
D. 抗原经皮下或肌内注射易形成耐受
E. TD-Ag无论多少剂量均不易引起T细胞耐受

正确答案：A。抗原的持续存在是维持免疫耐受的重要条件